有关妊娠期血液成分的变化不正确的是
A. 多种凝血因子均增加
B. 妊娠期凝血酶原时间轻度缩短
C. 血浆纤维蛋白原比非孕时增加50%
D. 凝血时间缩短
E. 纤维蛋白溶解时间延长

正确答案：D。凝血时间缩短

解析：妊娠期血液处于高凝状态：①凝血因子Ⅱ、Ⅴ、Ⅶ、Ⅷ、Ⅸ、Ⅹ增加，仅凝血因子Ⅺ、ⅩⅢ降低；②血小板数无明显改变；③血浆纤维蛋白原含量比非孕妇女约增加50%；④妊娠晚期凝血酶原时间及活化部分凝血活酶时间轻度缩短，凝血时间无明显改变；⑤妊娠期纤溶酶原显著增加，优球蛋白溶解时间明显延长，表明妊娠期间纤溶活性降低；⑥于妊娠末期红细胞沉降率加快。掌握“妊娠生理”知识点。